《金匮》中指出的苓桂术甘汤和肾气丸可同治的一种病证是
A. 消渴
B. 狭义痰饮
C. 虚劳腰痛
D. 支饮
E. 正水

正确答案：B。狭义痰饮

解析：微饮是水饮轻微者，饮邪虽轻微，但其本在脾肾之阳不化，故必须早为图治。水饮内停，妨碍气机升降则短气，气化不行则小便不利。要使气机畅达，必先除其水饮。尤在泾说：“欲引其气，必蜀其饮。”“治水饮可用利小便的方法，故“当从小便去之”是本证治法。化气利小便，使气化水行，饮有去路，则短气之症自除。但饮邪的形成，有因中阳不振，不能运化水湿，水停为饮者，其本在脾，必兼见胸胁支满、头晕目眩、心下悸动等症，治宜健脾渗湿，通阳利水，方用苓桂术甘汤；亦有下焦阳虚。不能化气行水，以致水气上泛心下者，其本在肾，兼见畏寒足冷、腰酸、少腹拘急不仁等症，治宜温肾蠲饮，化气行水，方用肾气丸。两方皆属“温药和之”之治，但治脾、治肾则各有不同（B对）。